男，52岁。上腹痛伴进行性黄疸1个月，感觉乏力食欲不振，症状逐渐加重；查体：腹部膨隆，腹软未触及包块，肠鸣音弱，CA19-9和CEA增高。为诊断和设计手术方案，最有意义的检查方法是
A. ERCP
B. MRI
C. 上消化道钡餐造影
D. 增强CT
E. 腹部B超

正确答案：D。增强CT

解析：患者中年男性，上腹痛伴进行性黄疸1个月，感觉乏力食欲不振，症状逐渐加重；查体：腹部膨隆，腹软未触及包块，肠鸣音弱，血CA19-9和CEA增高（腹腔肿瘤，尤其用于胰腺癌的辅助诊断）。根据患者临床表现、体格检查、实验室检查，怀疑为胰腺癌，腹部增强CT（D对）可作为胰腺肿瘤病人的首选影像学检查手段。腹部超声（A错）可显示肝内外胆管扩张，胆囊胀大，胰管扩张，胰头部占位病变，同时可观察有无肝转移和淋巴结转移，由于胃、肠等脏器的遮挡，腹部超声的诊断性不如增强CT。单纯腹部MRI（B错）诊断并不优于增强CT。上消化道钡剂造影（C错）用于诊断上消化道黏膜皱襞的形态与缺损。ERCP（内镜逆行胰胆管造影）（E错）用于观察十二指肠、乳头部病变及胆道系统和胰腺胆管的解剖和病变，对胰腺癌无诊断作用。